含苯乙烯基的药物
A. 己烯雌酚
B. 醋酸甲地孕酮
C. 达那唑
D. 醋酸氟轻松
E. 醋酸泼尼松龙

正确答案：A。己烯雌酚